患者男性，50岁，急性心肌梗死过程中，突然出现心尖区粗糙响亮的收缩期杂音，此时应考虑的并发症是
A. 室壁瘤形成
B. 急性左心功能不全致二尖瓣相对关闭不全
C. 瓣膜穿孔
D. 急性乳头肌功能不全
E. 室间隔穿孔

正确答案：D。急性乳头肌功能不全

解析：心尖部收缩期杂音是乳头肌功能不全的最重要体征，伴随心绞痛出现的乳头肌功能不全，心尖部的收缩期杂音响度随心绞痛的发作而变化，急性乳头肌断裂的杂音具有突然出现的全收缩期和粗糙的特点，常伴有舒张期奔马律或第四心音（D对）。心室壁瘤主要见于左心室，体格检查可发现左侧的心界扩大，出现室壁瘤后，心尖搏动较广泛，听诊可听到收缩期杂音，多数是见于急性心肌梗死后出现，多发生于游离壁和心尖部（A错）。二尖瓣相对关闭不全可闻及心尖部较粗糙的吹风样全收缩期杂音范围广泛（B错）。瓣膜穿孔可闻及音样杂音为高调（C错）。室间隔穿孔可闻及在心前区胸骨左缘突然出现的粗糙的全收缩期杂音，并且触及震颤（E错）。